女性，55岁。3个月来腹胀，食欲不振、低热，查体：腹饱满，移动性浊音（+），抗结核治疗2周不见好转，为进一步明确诊断，应做哪项检查
A. 腹腔积液常规
B. 血沉
C. 腹腔镜+活检
D. 全胃肠钡餐造影
E. 剖腹探查

正确答案：C。腹腔镜+活检

解析：中老年女性患者，低热（结核毒血症状）、食欲不振伴腹胀3个月。查体：移动性浊音阳性（腹水阳性），疑诊为结核性腹膜炎，予抗结核治疗（2～4周）有效可确诊。而该患者抗结核治疗2周不见好转，为进一步明确诊断，应做腹腔镜+活检（C对），这是诊断结核性腹膜炎的金标准。腹腔积液常规（A错）可分辨腹腔积液性质，其中ADA（腺苷脱氢酶）活性增高对结核性腹膜炎诊断有一定特异性，但并不能确诊该病。血沉（B错）增高可见于多种疾病，如急性炎症、白血病、结缔组织病及结核病的活动期，不具有特异性。全胃肠钡餐造影（D错）可发现肠粘连、肠结核、肠瘘、肠腔外肿块等征象，对结核性腹膜炎无确诊价值。剖腹探查（E错）对患者损伤大，适用于本病诊断困难、与急腹症不能鉴别时（P372），该患者无明显急腹症症状及体征，故不应进行剖腹探查。